当归四逆汤适应证的脉象是
A. 脉微欲绝
B. 脉细欲绝
C. 脉沉伏不出
D. 脉沉微
E. 脉微细

正确答案：B。脉细欲绝

解析：手足厥寒，当察气血阴阳，辨其寒热虚实。四肢逆冷，脉微欲绝，属少阴阳衰、阴寒内盛之寒厥证。今手足厥寒，而不言四肢逆冷，说明其厥逆的范围仅在手足而未过肘膝，其程度是虽寒而不至于冷，即本证厥逆的程度较寒厥证的四肢逆冷为轻。脉细欲绝与脉微欲绝有别，细主血虚，微主阳虚。本证手足厥寒与脉细欲绝并见，是血虚感寒，寒凝经脉，气血运行不畅，四末失于温养所致，故治以当归四逆汤养血通脉，通经散寒（B对）。